依据十二经脉流注次序，肾经下接的经脉是
A. 手少阴心经
B. 手厥阴心包经
C. 手少阳三焦经
D. 足阳明胃经
E. 足太阴脾经

正确答案：B。手厥阴心包经

解析：十二经脉的气血流注从肺经开始逐经相传，至肝经而终，再由肝经复传于肺经，流注不已，从而构成了周而复始、如环无端的循环传注系统，其顺序是手太阴肺经→手阳明大肠经→足阳明胃经→足太阴脾经→手少阴心经→手太阳小肠经→足太阳膀胱经→足少阴肾经→手厥阴心包经→手阳明小肠经→足少阳胆经→足厥阴肝经。依据十二经脉流注次序，肾经下接的经脉是手厥阴心包经（B对）。歌诀：肺大胃脾心小肠，膀肾包焦胆肝详。